某男，42岁，胃痛已十余年，多在受凉或吃生冷食物后发作，疼痛较剧烈，喜按喜热，食欲尚好，大便正常，舌淡苔白润，脉沉弦。临床诊断最可能是
A. 胃寒证
B. 脾阳虚证
C. 脾气虚证
D. 寒湿困脾证
E. 胃气虚证

正确答案：A。胃寒证

解析：寒邪犯胃,凝滞气机,不通则痛,故胃脘冷痛,痛势急剧；寒邪得温则散,故疼痛得温则减；遇寒气机凝滞加重,则痛势加剧；舌淡苔白润,脉弦紧或沉紧,为阴寒内盛之象（A对）。